稳定性心绞痛需要长期多次服用的首选药是
A. 硝酸甘油
B. 硝苯地平（心痛定）
C. 普萘洛尔
D. 硝酸异山梨醇酯
E. 双嘧达莫

正确答案：D。硝酸异山梨醇酯

解析：硝酸甘油（A错）适用于治疗各种类型的心绞痛，其中对稳定型心绞痛为首选药，但由于硝酸甘油维持时间短，不宜作为长期预防用药。硝酸异山梨醇酯（D对）作用与硝酸甘油相似而作用强度较弱，也为稳定型心绞痛的首选药，并且持续时间长，适用于长期治疗预防心绞痛的发作。硝苯地平（B错）扩张冠状动脉作用强，可解除冠脉痉挛，对变异型心绞痛效果好，对稳定性心绞痛作用不及β受体阻断药，二者可联合应用，降低不良反应。对于稳定型心绞痛，普萘洛尔（C错）主要用于对硝酸酯类药物不敏感或疗效差的患者，以减少心绞痛发作的次数和程度。双嘧达莫（E错）可抑制血小板的聚集，从而抑制血栓的形成，可用于预防动脉粥样硬化，不属于心绞痛的首选治疗药物。